慢乙酰化代谢患者使用异烟肼治疗肺结核时，会导致体内维生素B₆缺乏，易发生的不良反应是
A. 肝坏死
B. 溶血
C. 多发性神经炎
D. 系统性红斑狼疮
E. 呼吸衰竭

正确答案：C。多发性神经炎

解析：本题考查异烟肼的不良反应。异烟肼导致体内维生素B₆耗竭，GABA合成减少，谷氨酸堆积，引起对中枢和外周神经系统的毒性作用，引发多发性神经炎（C对）。